关于责任、应当的理论，以研究道德准则或规范，即社会和人们根据哪些标准来判断行为者的行为是正当，以及行为者应负的道德责任的是伦理学基本理论中的
A. 效果论
B. 美德论
C. 义务论
D. 阶级论
E. 规范论

正确答案：C。义务论

解析：义务论又称道义论，是关于责任、应当的理论，主要思考的是在社会中人们应该做什么和不应该做什么。义务论以研究道德准则或规范，即社会和人们根据哪些标准来判断行为者的行为是正当的，以及行为者应负的道德责任。掌握“伦理学”知识点。